进口麻醉药品时，须有
A. 麻醉药品专用卡
B. 麻醉药品购用印鉴卡
C. 麻醉药品专用章
D. 麻醉药品进口注册证
E. 麻醉药品进口许可证

正确答案：E。麻醉药品进口许可证

解析：本题考查药品进口管理。进口麻醉药品时，须有麻醉药品进口许可证（E对）。进口、出口麻醉药品和国家规定范围内的精神药品，应当持有国务院药品监督管理部门颁发的进口准许证、出口准许证。